女孩，3岁。身高70cm，智力低下，鼻梁低平，舌体宽厚，常伸出口外，腹轻胀，便秘，有脐疝。最可能的诊断是
A. 黏多糖病
B. 先天性甲状腺功能减低症
C. 21-三体综合征
D. 骨软骨发育不良
E. 先天性巨结肠

正确答案：B。先天性甲状腺功能减低症

解析：患儿，生长发育低下、智力低下、消化能力低下，并且有鼻梁低平、舌体宽厚、常伸出口外的特殊面容，应诊断为先天性甲状腺功能减低症（B对）。骨软骨发育不良（D错）和黏多糖病（A错）都是骨骼系统病变，不会有智力方面的改变。21-三体综合征虽然也会有智力障碍，但是还有另一个典型的特征：通贯掌，该患儿无此特征，因此不能诊断为21-三体综合征（C错）。先天性巨结肠是消化系统病，可有腹胀、便秘的表现，然而不会有智力低下的特征（E错）。